不能用作桥体龈端的材料是
A. 塑料桥体
B. 硬质树脂桥体
C. 金属与非金属联合桥体
D. 金属桥体
E. 陶瓷桥体

正确答案：A。塑料桥体

解析：按桥体所用材料不同分类：①金属桥体：由金属制作，其机械强度高，但影响美观，因此适用范围小，只适用于后牙缺失的固定桥修复。但在（牙合）龈距离小的病例，采用该桥体能防止桥体折断。②非金属桥体：塑料桥体由于材料硬度低，易磨损，化学性能不稳定，易老化变色，对黏膜刺激性大，故仅用于制作暂时性固定桥。硬质树脂桥体随着材料性能的改善，可用于永久性修复体。瓷材料经过长时间的发展后性能提升较大，已经能够制作永久性固定桥的桥体。③金属与非金属联合桥体：兼有金属与非金属两者的优点，故为临床上普遍采用。金属与树脂联合桥体适用于前牙和后牙固定桥修复，烤瓷熔附金属桥体是临床上应用最为广泛的桥体类型。掌握“固定桥的设计”知识点。